可持续发展目标（SDG）以综合方式解决（）三个维度的发展问题
A. 科技、文化和政治
B. 政治、经济和文化
C. 社会、经济和环境
D. 政治、科技和经济
E. 政治、经济和法制

正确答案：C。社会、经济和环境